不属于细菌类疫苗的是
A. 细菌减毒活疫苗
B. 细菌灭活疫苗
C. 多糖疫苗
D. 类毒素疫苗
E. 抗毒素

正确答案：E。抗毒素